面颊部开放性损伤，受伤后12h来就诊，检查无感染坏死情况，局部处理应
A. 作感染伤口处理、换药、不清创
B. 清创后不予缝合
C. 清创后延期缝合
D. 清创后一期缝合
E. 以上均不是

正确答案：D。清创后一期缝合

解析：颌面部创口由于血液循环丰富、组织抗感染能力强，确认无感染坏死情况，超出6～8小时常规清创缝合期时，仍可做清创处理和早期缝合创口。此患者局部处理应该为清创后行一期缝合。掌握“创伤和战伤”知识点。